对卡培他滨引起的手足综合征，初期可告知患者采取的处置方式是
A. 反复搓揉手脚
B. 外用糖皮质激素软膏
C. 穿戴宽松的鞋袜和手套
D. 一旦发生，立即停药
E. 增加阳光照射

正确答案：C。穿戴宽松的鞋袜和手套

解析：本题考查抗肿瘤药物的皮肤不良反应。卡培他滨等药物可引起手足综合征，初期表现为手掌、足底、指（趾）末端感觉异常、刺痛感、麻木、充血，可伴有皮肤增厚、粗糙等，继而出现疼痛、皲裂、脱皮，严重患者可出现水庖、溃疡伴随剧烈疼痛；可告知患者采取如穿戴宽松的鞋袜和手套（C对），避免反复揉搓手脚（A错），避免长时间阳光直射（E错）等措施予以预防；一旦出现手足综合征，可根据其严重程度和发生次数暂停或减量用药（D错）。